患者，女，20岁。经行腹痛，月经量多，色紫有块，少腹冷痛，舌体紫暗有瘀斑，脉细涩。用药宜首选
A. 陈皮、白芍、熟地
B. 川芎、丹参、红花
C. 阿胶、川芎、黄芪
D. 当归、桃仁、牛膝
E. 丹参、生地、红花

正确答案：B。川芎、丹参、红花

解析：经行腹痛，月经量多，色紫有块，少腹冷痛，舌体紫暗有瘀斑，脉细涩，为血瘀之证，治疗当选用活血化瘀较强的一组药物进行治疗，川芎、丹参、红花具有较强的活血功效（B对）。陈皮：理气健脾，燥湿化痰。白芍：养血调经，敛阴止汗，柔肝止痛，平抑肝阳。熟地：补血滋阴，益精填髓（A错）。阿胶：补血滋阴，养心安神。黄芪：补气升阳，固表止汗，利水消肿，生津养血，行滞通痹，托毒排脓，敛疮生肌（C错）。当归：补血活血，调经止痛，润肠通便。桃仁：活血祛瘀，润肠通便，止咳平喘。牛膝：活血祛瘀，补肝肾，强筋骨，利水通淋，引火下行（D错）。生地：清热凉血，养阴生津（E错）。